医药零售商店均不能销售
A. 麻醉药品
B. 精神药品原料
C. 一类精神药品制剂
D. 二类精神药品
E. 毒性药品

正确答案：A、B、C。麻醉药品；精神药品原料；一类精神药品制剂

解析：本题考查定点经营。医药零售商店均不能销售麻醉药品（A对）、精神药品（B对）、一类精神药品制剂（C对）。根据《麻醉药品和精神药品管理条例》第二十二条的规定：药品经营企业不得经营麻醉药品原料药和第一类精神药品原料药。